关于脊髓灰质炎减毒活疫苗，哪项错误
A. 可刺激肠黏膜产生SIgA
B. 可刺激机体产生血清IgM、IgG
C. 秋冬季节服用效果最佳
D. 避免各型疫苗间的干扰
E. 可在室温下长期保存

正确答案：E。可在室温下长期保存